在下列各项中，属于医患关系暂时不协调的是
A. 医患关系的民主化
B. 医患要求的多元化
C. 医患关系的物化
D. 医患纠纷的增多
E. 医患关系的法制化

正确答案：D。医患纠纷的增多